下列不属于纯热能食物的是
A. 蔗糖
B. 葡萄糖
C. 肉类
D. 白酒
E. 淀粉

正确答案：C。肉类